淋病的病原菌为
A. 溶血型链球菌
B. 梭形杆菌
C. 金黄色葡萄球菌
D. 淋病双球菌
E. 螺旋体

正确答案：D。淋病双球菌

解析：本题考查淋病奈瑟菌。淋病的病原菌为淋病双球菌（D对）。溶血型链球菌（A错）可为某些化脓性感染、猩红热、风湿热和急性肾小球肾炎等的病原体。梭形杆菌（B错）可为口腔感染的病原体。金黄色葡萄球菌（C错）可为某些化脓性感染、烫伤样皮肤综合征、毒性休克综合征等的病原体。螺旋体（E错）是梅毒、雅司病、品他病、莱姆病等的病原体。